麦芽是常用的消食药，关于其性能特点的说法错误的是
A. 甘益中
B. 平不偏
C. 芽生发
D. 焦健胃
E. 辛消散

正确答案：E。辛消散

解析：本题考查的是麦芽的性能特点。麦芽是常用的消食药，关于其性能特点的说法错误的是辛消散（E错，为本题正确答案）。麦芽：【性能特点】本品甘益中（A对），平不偏（B对），芽生发（C对），焦味健胃（D对）。主入脾、胃经，善消食健胃和中，治饮食积滞，尤宜米、面、薯、芋等食积者；兼入肝经，生用疏肝，辅治肝郁气滞及肝胃不和。此外，大量用回乳消胀，用于断乳、乳房胀痛等。莱菔子：【性能特点】本品辛消散，甘益中，平不偏，能升能降。入脾、胃经，善消食除胀，治食积胀满；入肺经，善降气消痰，治痰壅咳喘。习有“生升熟降”之说。